用于黄酮类化合物的显色反应是
A. 碘-碘化钾反应
B. 甲基化反应
C. 酶解反应
D. 乙酰化反应
E. 盐酸-镁粉反应

正确答案：E。盐酸-镁粉反应

解析：本题考查的是黄酮类化合物的显色反应。用于黄酮类化合物的显色反应是盐酸-镁粉反应（E对）。黄酮的显色反应：黄酮类化合物的显色反应多与分子中的酚羟基及γ-吡喃酮环有关。1.还原试验：（1）盐酸-镁粉（或锌粉）反应；（2）四氢硼钠（钾）反应；2.金属盐类试剂的络合反应：（1）铝盐；（2）铅盐；（3）锆盐；（4）镁盐；（5）氯化锶；（6）三氯化铁；3.硼酸显色反应；4.碱性试剂显色反应。